可以在中药材专业市场交易的药品是
A. 常用的中成药
B. 有批准文号的化学原料药
C. 放开价格的药品
D. 家种、家养中药材
E. 经炮制加工的中药饮片

正确答案：D。家种、家养中药材

解析：本题考查中药材专业市场交易。可以在中药材专业市场交易的药品是家种、家养中药材（D对）。《药品管理法》及其实施条例规定，城乡集市贸易市场可以出售中药材，国务院另有规定的除外。另外，《关于进一步加强中药材管理的通知》指出：除现有17个中药材专业市场外，各地一律不得开办新的中药材专业市场。进入中药材专业市场经营中药材者应具有专业人员并取得证照且经营自产中药材，而且必须遵纪守法，明码标价，按章纳税。